某女，45岁。月经延后13天，经量少，色暗淡，质清稀，腰膝酸软，头晕耳鸣，面色晦暗；舌淡，苔薄白，脉沉细。辨析其证候是
A. 血虚证
B. 肾虚证
C. 痰湿证
D. 气滞证
E. 寒凝证

正确答案：B。肾虚证

解析：本题考查月经后期之肾虚证的症状。辨析其证候是月经后期之肾虚证（B对）。月经后期之肾虚证【症状】月经周期延后，经量少，色暗淡，质清稀，或带下清稀；腰膝酸软，头晕耳鸣，面色晦暗，或面部暗斑。舌淡，苔薄白，脉沉细。月经后期之血虚证（A错）【症状】月经周期延后，经量少，色淡红，质清稀，或小腹绵绵作痛；或头晕眼花，心悸少寐，皮肤不润，面色苍白或萎黄。舌质淡红，苔薄白，脉细弱。月经后期之痰湿证（C错）【症状】月经周期延后，量少，色淡红，质黏稠；头晕体胖，心悸气短，脘闷恶心，口腻多痰，或带下量多黏腻。舌淡胖，苔白腻，脉滑。月经后期之气滞证（D错）【症状】月经周期延后，量少或正常，色暗红或有血块，小腹胀痛；或精神抑郁，胸胁乳房胀痛。舌质正常或红，苔薄白或微黄，脉弦或弦数。痛经之寒凝（E错）血瘀证【症状】经行小腹冷痛，得热则舒，经量少，色紫暗有块；形寒肢冷，小便清长。脉细或沉紧。